疾病的流行强度包括
A. 散发、暴发、流行
B. 流行、续发、暴发
C. 续发、继发、散发
D. 散发、大流行、续发

正确答案：A。散发、暴发、流行

解析：本题考查疾病的流行强度。疾病流行强度常用散发、暴发、流行（A对BCD错）及大流行表示，指在一定时期内疾病在某地区人群中发病率的变化及其病例间的联系程度。